肌酸的合成原料是
A. 精氨酸和瓜氨酸
B. 精氨酸和甘氨酸
C. 精氨酸和鸟氨酸
D. 鸟氨酸和甘氨酸
E. 鸟氨酸和瓜氨酸

正确答案：B。精氨酸和甘氨酸

解析：肌酸可以由精氨酸、甘氨酸和S-腺苷甲硫氨酸为前体在人体肝脏、肾脏和胰脏合成。掌握“个别氨基酸代谢”知识点。